左心衰竭最早出现的临床症状是
A. 疲乏无力
B. 劳力性呼吸困难
C. 阵发性夜间呼吸困难
D. 夜间卧床时咳嗽
E. 失眠、尿少、头晕

正确答案：B。劳力性呼吸困难

解析：劳力性呼吸困难是左心衰竭最早出现的症状，系因运动使回心血量增加，左心房压力升高，加重了肺淤血。引起呼吸困难的运动量随心衰程度加重而减少。随着心功能不全的加重，患者可出现于夜间入睡后突然发生胸闷、气急而被迫坐起，即夜间阵发性呼吸困难。掌握“心力衰竭”知识点。